肺的阴阳属性是
A. 阳中之阳
B. 阳中之阴
C. 阴中之阳
D. 阴中之阴
E. 以上都不是

正确答案：B。阳中之阴

解析：心与肺都在人体膈上，上部属阳。而肺主肃降，具有阴的特性，所以肺是阳中之阴（B对）。